对鉴别急性呼吸窘迫综合征（ARDS）与心源性肺水肿最有价值的检查是
A. 肺功能
B. 超声心动图
C. 动脉血气分析
D. 胸部X线片
E. Swan-Ganz导管

正确答案：E。Swan-Ganz导管

解析：急性呼吸窘迫综合征（ARDS）与心源性肺水肿最有价值的检查是Swan-Ganz导管（E对）。Swan-Ganz导管可测定肺动脉楔压（PAWP）这是反映左心房压较为可靠的指标，心源性肺水肿PAWP﹥18mmHg。肺功能（A错）主要对某些早期肺部疾病的早期诊断具有重要价值。超声心动图（B错）主要检查心脏的结构和运动状态。动脉血气分析（C错）是判断机体是否存在酸碱平衡失调以及缺氧和缺氧程度的可靠指标。胸部X线（D错）对于明确肺部病变部位、性质以及有关气管、支气管通畅程度有重要价值。